曲妥珠单抗的适应证是
A. 人表皮生长因子受体-2（HER-2）过度表达的乳腺癌
B. 晚期恶性黑色素瘤
C. 表皮生长因子受体（EGFR）基因突变阴性的转移性非小细胞肺癌
D. 转移性结直肠癌
E. 复发或耐药的滤泡性中央型淋巴瘤

正确答案：A。人表皮生长因子受体-2（HER-2）过度表达的乳腺癌

解析：本题考查曲妥珠单抗。曲妥珠单抗用于人表皮生长因子受体-2(HER-2）过度表达的乳腺癌（A对）。帕博丽珠单抗用于晚期恶性黑色素瘤（B错）的二线治疗。纳武利尤单抗用于表皮生长因子受体(EGFR）基因突变阴性的转移性非小细胞肺癌（C错）。贝伐珠单抗用于转移性结直肠癌（D错）。利妥昔单抗用于复发或耐药的滤泡性中央型淋巴瘤（E错）。